与牙周炎关系密切的全身疾病是
A. 肺炎
B. 胆囊炎
C. 胃炎
D. 肾病
E. 糖尿病

正确答案：E。糖尿病

解析：糖尿病伴发牙周病的病理机制可能是白细胞趋化和吞噬功能缺陷、组织内血管基底膜的改变、胶原合成减少、骨基质形成减少，以及免疫调节能力下降，使患者的抗感染能力下降、伤口愈合障碍。近年来发现，糖化末端产物（AGES）与其细胞受体（RAGE）作用的加强是糖尿病患者牙周病加重的机制。掌握“牙周疾病促进因素”知识点。